胃阴虚证在饮食方面的特征是
A. 不饥少食
B. 厌食油腻
C. 消谷善饥
D. 饥不欲食
E. 饥而能食

正确答案：D。饥不欲食

解析：胃阴不足，虚热内生，胃失濡润，气失和降，则胃脘隐隐灼痛，嘈杂不舒；胃中虚热扰动，则饥，然胃虚失于和降，故不欲食（D对）。不饥少食多见于胃气虚（A错）。厌食油腻多见于胃肠内有实热（B错）。消谷善饥多见于胃热炽盛（C错）。饥而能食多见于正常人（E错）。